关于《“十三五”国家药品安全规划》确定的保障药品安全发展目标和主要任务的说法，错误的是
A. 到2020年，完成批准上市的仿制药与原研药质量和疗效的一致性评价
B. 到2020年，药品监测评价能力达到国际先进水平，药品定期发全性更新报告评价率达100%
C. 到2020年，药品、医疗器械市评审批体系逐步完善，实现按规定时限评审审批
D. 到2020年，每万人口执业药师数超过4人，所有零售药店主要管理者具备执业药师资格，营业时有执业药师指导合理用药

正确答案：A。到2020年，完成批准上市的仿制药与原研药质量和疗效的一致性评价

解析：本题考查考查我国药品安全管理的目标任务。“药品质量进一步提高”中规定：批准上市的仿制药与原研药质量和疗效一致。分期分批对已上市的药品进行质量和疗效一致性评价（A错，为本题正确答案）。